拮抗药的特点是
A. 对受体亲和力强，无内在活性
B. 对受体亲和力强，内在活性弱
C. 对受体亲和力强，内在活性强
D. 对受无体亲和力，无内在活性
E. 对受体亲和力弱，内在活性弱

正确答案：A。对受体亲和力强，无内在活性

解析：本题考查作用于受体药物的分类。拮抗药的特点是对受体亲和力强，无内在活性（A对）。拮抗药是指能与受体结合，具有较强亲和力而无内在活性（α=0）的药物。对受体亲和力强，内在活性弱（B错）的是部分激动药。对受体亲和力强，内在活性强（C错）的是完全激动药。